与胃癌发病关系密切的病理改变是
A. Barrett上皮
B. 胃上皮化生
C. 乳头状瘤
D. 胃黏膜上皮细胞异型増生
E. 黏膜中性粒细胞浸润

正确答案：D。胃黏膜上皮细胞异型増生

解析：与胃癌发病关系密切的病理改变即胃癌的癌前病变，其主要表现是胃粘膜上皮细胞异型增生（D对）。Barrett上皮（A错）（P350）与食管癌有关。胃上皮化生（B错）（P355）是长期慢性炎症导致的，分布范围越广，发生胃癌的危险性越高。乳头状瘤（C错）（八年制病理学第二版P130）为良性病变。黏膜中性粒细胞浸润（E错）（八年制病理学第二版P257）是炎性浸润的一般表现。